甲亢病人突然出现下肢不能动，血钾2.1mmol/L，最可能的是下列哪种疾病
A. 重症肌无力
B. 周期性麻痹
C. 周围神经炎
D. 甲亢性肌病
E. 肌营养不良症

正确答案：B。周期性麻痹

解析：周期性麻痹是一组反复发作的以骨骼肌迟缓性瘫痪为特征的肌病，与钾代谢异常有关，分为低钾型、高钾型、正常钾型周期性瘫痪。甲亢常伴发周期性麻痹（B对）。甲亢伴重症肌无力（A错）主要累及眼部肌群，表现为上睑下垂，眼球活动障碍，复视等。周围神经炎（C错）为糖尿病常见并发症，在甲亢患者中罕见，且主要表现为感觉障碍。甲亢性肌病（D错）主要表现为近端肌群肌无力、萎缩，以肩胛带和骨盆带肌群为主，很少累及下肢肌。肌营养不良症（E错）主要表现为进行性加重的骨骼肌萎缩和无力。